细胞壁中含大量脂类的细菌是
A. 白喉棒状杆菌
B. 淋病奈瑟菌
C. 金黄色葡萄球菌
D. 伤寒沙门菌
E. 结核分枝杆菌

正确答案：E。结核分枝杆菌

解析：本题考查细胞壁中的脂类细菌。细胞壁中含大量脂类的细菌是结核分枝杆菌（E对）。结核分枝杆菌的众多生物学特性都与细胞壁中含大量脂质有关。白喉棒状杆菌（A错）、淋病奈瑟菌（B错）、金黄色葡萄球菌（C错）、伤寒沙门菌（D错）均不是细胞壁中含有的大量脂类细菌。